与闭合复位相比较，骨折的切开复位较易
A. 缩短骨折愈合时间
B. 减少骨折部位创伤
C. 增加骨不愈合发生的可能性
D. 降低感染风险
E. 制动时间延长

正确答案：C。增加骨不愈合发生的可能性